下列情况中，能引起肾小球滤过率减少的是
A. 血浆胶体渗透压减低
B. 血浆胶体渗透压升高
C. 血浆晶体渗透压降低
D. 血浆晶体渗透压升高
E. 肾小球毛细血管血压升高

正确答案：B。血浆胶体渗透压升高